患者，男，48岁，诊断为2型糖尿病。经生活方式干预，血糖控制仍不佳，拟开始单药治疗，宜选用的药物是
A. 门冬胰岛素
B. 二甲双胍
C. 甘精胰岛素
D. 阿卡波糖
E. 格列美脲

正确答案：B。二甲双胍

解析：本题考查二甲双胍。宜选用的药物是二甲双胍（B对）。如果单纯生活方式干预不能使血糖控制达标，应开始单药治疗。2型糖尿病的首选治疗药物是二甲双胍，若无禁忌症，二甲双胍应一直保留在糖尿病的药物治疗方案中。不耐受二甲双胍治疗者，可选择α-葡萄糖苷酶抑制剂（阿卡波糖（D错））或促胰岛素分泌剂（包括磺酰脲类药物如格列美脲（E错）和格列奈类药物）。胰岛素（AC错）治疗是控制高血糖的重要手段，当口服降糖药效果不佳或存在口服药使用禁忌时，需应用胰岛素控制高血糖，并降低糖尿病并发症的发生危险。